TAP
A. 参与外源性抗原的提呈
B. 参与内源性抗原的提呈
C. 位于内体膜上
D. 为同源二聚体分子
E. 对多肽进行被动转运

正确答案：B。参与内源性抗原的提呈